下列属于剖宫产绝对指征的是
A. 骶耻外径15cm
B. 枕后位
C. 持续性枕横位
D. 部分性前置胎盘
E. 完全臀先露

正确答案：A。骶耻外径15cm

解析：骶耻外径为15cm（正常值为18～20cm）（A对）时，其骨盆入口前后径约为6～8cm（骶耻外径值减去1/2尺桡周径值，即相当于骨盆入口前后径值），对角径约为8～9.5cm（对角径减去1.5～2cm为骨盆入口前后径），符合剖宫产的指征（P195）（骨盆入口前后径≤8cm，对角径≤9.5cm，足月活胎不能入盆，应行剖宫产术）。枕后位（B错）时，如胎头俯屈较好，可经阴道分娩。持续性枕横位（C错）用手旋转至正常胎位后，可经阴道分娩。部分性前置胎盘（D错）存在出血较多，短时间不能结束分娩，有胎心异常等情况时，才需行剖宫产术。完全臀先露（P204）（E错）在妊娠30周前可自行转为头先露，30周后可通过外转胎位术等方法矫正后经阴道分娩。